以下属于川崎病特异性诊断标准的是
A. 球结膜充血伴脓性分泌物
B. 指/趾末端膜状脱皮
C. 肛周皮肤发红、脱皮
D. 肝脾肿大
E. 卡介苗接种处发红

正确答案：B。指/趾末端膜状脱皮

解析：川崎病的诊断标准：发热5天以上，伴下列5项临床表现中4项者，排除其他疾病后，即可诊断为川崎病：（1）四肢变化：急性期掌跖红斑，手足硬性水肿；恢复期指趾端膜状脱皮（B对）（2）多形性皮疹（3）眼结合膜充血，非化脓性（A错）（4）唇充血皲裂，口腔黏膜弥漫充血，舌乳头突起、充血呈草苺舌（5）颈部淋巴结肿大。注：如5项临床表现中不足4项，但超声心动图有冠状动脉损害，亦可确诊为川崎病（P166）。川崎病是特异性免疫疾病，属于体液免疫反应而导致的全身血管炎性疾病，化脓反应不明显，故球结膜充血但不化脓（A错）。肛周皮肤发红、脱皮（C错）、肝脾肿大（D错）、卡介苗接种处发红（E错）均是该病可有临床表现，但非诊断标准。